前列腺增生患者最早出现的症状是
A. 肉眼血尿
B. 尿频
C. 尿潴留
D. 进行性排尿困难
E. 尿急

正确答案：B。尿频

解析：前列腺增生患者最早出现的症状是前列腺充血刺激引起的尿频（B对）。肉眼血尿（A错）最常见于泌尿系肿瘤，前列腺增生患者增生腺体表面黏膜较大的血管破裂时，亦可发生不同程度的无痛性肉眼血尿。尿潴留（C错）是前列腺突然充血、水肿导致。排尿困难（D错）是前列腺增生最重要的症状，发展缓慢，不属于最早出现的症状。尿急（E错）属于膀胱刺激征，前列腺增生合并感染或结石时常见。